关于腐殖质，下列说法不对的是
A. 化学性质稳定
B. 病原菌消灭
C. 有臭味
D. 含氮量高
E. 有机物

正确答案：C。有臭味

解析：本题考查腐殖质的相关内容。腐殖质是有机物（E对）经过土壤微生物分解后再合成的一种褐色或暗褐色的大分子胶体物质。腐殖质的存在使土壤具有一定的净化能力，一方面腐殖质通常带有电荷，具有较强的吸收、缓冲性能，对土壤的理化性质和生物学性质有重要影响。另一方面腐殖质的化学性质稳定（A对），病原体已经死灭（B对），不招引苍蝇，无不良气味（C错，为本题正确答案），质地疏松，含氮量高（D对），在卫生上是安全的，又是农业上良好的肥料。